决定Ig类和亚类的部位
A. V区
B. C区
C. 绞链区
D. 重链
E. 轻链

正确答案：D。重链